乌鸡白凤丸除补气养血外，又能
A. 活血通络
B. 除烦安神
C. 理气疏肝
D. 理气止痛
E. 调经止带

正确答案：E。调经止带

解析：本题考查的是乌鸡白凤丸的功能。乌鸡白凤丸除补气养血外，又能调经止带（E对）。乌鸡白凤丸：【功能】补气养血，调经止带。消栓胶囊：【功能】补气活血通络（A错）。更年安片：【功能】滋阴清热，除烦安神（B错）。柴胡舒肝丸：【功能】疏肝理气（C错），消胀止痛。女金丸：【功能】益气养血，理气活血，止痛（D错）。